口测法体温的正常范围是
A. 36.5℃～37.0℃
B. 36.3℃～37.2℃
C. 36.5℃～37.7℃
D. 36.5℃～37.5℃
E. 36.2℃～37.2℃

正确答案：B。36.3℃～37.2℃

解析：口测法的体温正常值为36.3度～37.2度（B对），肛测法的体温正常值为36.5度～37.7度（C错），腋测法的体温正常值为36度～37度。